下列属于氯噻嗪的不良反应是
A. 诱发、加重青光眼
B. 易发生低血糖反应
C. 诱发哮喘、加重心衰
D. 导致出大汗、发生虚脱
E. 导致脱水、低血钾、电解质紊乱

正确答案：E。导致脱水、低血钾、电解质紊乱

解析：本题考查氯噻嗪的不良反应。下列属于氯噻嗪的不良反应是导致脱水、低血钾、电解质紊乱（E对）。氢氯噻嗪的不良反应：1.电解质紊乱。长期用药可致低血钾、低血钠、低血镁、低氯碱血症等，合用保钾利尿药可防治。2.高尿酸血症及高尿素氮血症。3.高钙血症。4.升高血糖（B错）。5.其他。偶致过敏性皮炎、粒细胞及血小板减少，以及胃肠道反应。